男性，30岁，腹部被自行车碾过，尚未明确诊断，观察期间错误的处理是
A. 禁饮禁食
B. 注射吗啡止痛
C. 反复检查腹部
D. 绝对卧床休息
E. 检测血压、脉搏

正确答案：B。注射吗啡止痛

解析：对于未明确诊断的腹部损伤患者，禁用吗啡等止痛药（B错，为本题正确答案）以免掩盖患者的伤情，延误诊断和治疗。本例患者为青年男性，腹部外伤史，怀疑有腹腔内脏器损伤，应禁饮、禁食（A对），以防加重病情；反复检查腹部（C对）利于了解腹腔内部脏器的病变进展，随时作出及时处理；绝对卧床休息（D对）可避免加重腹腔内出血，减轻胃肠道漏出液对腹膜的刺激，缓解疼痛；检测血压、脉搏（E对）为患者的常规检查有利于发现患者是否有休克症状。